树脂与牙、金属等形成粘接可提高亲和性的机制
A. 化学结合
B. 氢键结合
C. 相互混合
D. 分子间结合
E. 嵌合

正确答案：C。相互混合

解析：相互混合：粘接剂与被粘体粘接时，被粘体表面通过预处理，提高其亲和性，可在分子水平上发生相互混合而产生粘结力。掌握“修复材料、金瓷结合及树脂粘结机制”知识点。